不属于牙内陷范畴的是
A. 畸形舌侧窝
B. 畸形根面沟
C. 畸形舌侧尖
D. 牙中牙
E. 釉珠

正确答案：E。釉珠

解析：本题考查牙内陷。釉珠是牢固附着于牙骨质表面的釉质小块，大小似粟粒，呈球形，不属于牙内陷（E错，为本题的正确答案）。牙内陷是牙发育时期，成釉器过度卷叠或过度增殖，深入牙乳头所致，多发生于上颌侧切牙。根据其深浅及形态变异，临床上可将牙内陷分为：畸形舌侧窝（A对）、畸形根面沟（B对）、畸形舌侧尖（C对）和牙中牙（D对）。